面部出血时可压迫
A. 颌内动脉
B. 颌外动脉
C. 颞浅动脉
D. 颈总动脉
E. 唇动脉

正确答案：B。颌外动脉

解析：本题考查指压止血法。面动脉又称颌外动脉（B对），主要分支有上、下唇动脉，内眦动脉，颏下动脉和腭升动脉，其在面部行程弯曲，主要营养面部中下区域，颜面中下区域出血可压迫面动脉止血。颌内动脉（A错）又称上颌动脉，为供应口腔颌面部的主要动脉，分支较多，位置较深，在体表不易扪及。额部、头顶颞部出血时应在耳屏前压迫颞浅动脉（C错）。头面部广泛严重出血时暂时压迫颈总动脉（D错）可减少面部出血。唇动脉（E错）为面动脉分支，营养上下唇区域的组织。